国家建立统一的突发事件
A. 预防控制体系
B. 医疗救助方案
C. 日常监测
D. 应急演练
E. 技能培训

正确答案：A。预防控制体系

解析：《突发公共卫生事件应急条例》第十四条 国家建立统一的突发事件预防控制体系（A对）。医疗救助方案由国家医保局制定（B错）。日常监测，即指那些社会矛盾诱发的经济问题、保险公司过去发生过的同类事件、常规类事件（C错）。应急演练是指各级人民政府及其部门、企事业单位、社会团体等（以下统称演练组织单位）组织相关单位及人员，依据有关应急预案，模拟应对突发事件的活动（D错）。技能培训包括对员工的理论知识和实操能力的培训（E错）。